下列不属于枕骨大孔疝的常见症状是
A. 剧烈头痛呕吐
B. 颈项强直
C. 早期出现一侧瞳孔散大
D. 意识障碍
E. 呼吸骤停发生早

正确答案：C。早期出现一侧瞳孔散大

解析：枕骨大孔疝又称小脑扁桃体疝，指颅内压增高使小脑扁桃体及延髓经枕骨大孔推挤向椎管内。其常见症状有剧烈头痛、呕吐（A对），颈项强直（B对）等颅内压增高的症状；由于延髓等脑干结构受压、缺氧，早期可出现呼吸骤停（E对），晚期可有嗜睡、昏迷等意识障碍（D对）的表现；瞳孔变化多变（C错，为本题正确答案），可忽大忽小。